腋淋巴结不收集
A. 上肢的浅淋巴
B. 项背部浅淋巴
C. 上肢的深淋巴
D. 乳房内侧的淋巴
E. 胸腹前外侧壁的淋巴

正确答案：D。乳房内侧的淋巴

解析：上肢的浅淋巴（A对）、项背部浅淋巴（B对）、上肢的深淋巴（C对）、胸腹前外侧壁的淋巴（E对）均被腋淋巴结的5群所收集。乳房内侧的淋巴（D错，为本题正确答案）为胸骨旁淋巴结所收集。